头面部痛、温觉冲动传导通路，第1级神经元发出的轴突终止于
A. 面神经核
B. 三叉神经脊束核
C. 孤束核
D. 三叉神经中脑核
E. 脊束核、孤束核

正确答案：B。三叉神经脊束核

解析：参与头面部的痛温觉和触压觉传导通路的第一级神经元为三叉神经节内假单极神经元。第1级神经元发出的轴突终止于第2级神经元的胞体起始处，即在三叉神经脊束核（B对）和三叉神经脑桥核（D错）。